倦怠乏力，纳谷不馨，腹胀，属于
A. 喜证
B. 悲恐证
C. 忧思证
D. 惊证
E. 怒证

正确答案：C。忧思证

解析：忧思证表现为情志抑郁，忧愁不乐，表情淡漠，胸闷胁胀，善太息，失眠多梦，头晕健忘，心悸，倦怠乏力，纳谷不馨，腹胀，脉沉弦等。过度忧思，劳心伤脾，气血日耗，脾虚运化不利，则出现倦怠乏力，纳谷不馨，腹胀的症状（C对）。喜证表现为喜笑不休，心神不安，精神涣散，思想不集中，甚则语无伦次，举止失常，肢体疲软，脉缓等（A错）。悲恐证表现为善悲喜哭，精神萎靡，疲乏少力，面色惨淡；或胆怯易惊，恐惧不安，心悸失眠，常被恶梦惊醒，甚则二便失禁，或为滑精、阳痿等（B错）。惊证表现为情绪不安，表情惶恐，心悸失眠，甚至神志错乱，语言举止失常（D错）。怒证临床表现：烦躁多怒，胸胁胀闷，头胀头痛，面红目赤，眩晕，或腹胀、泄泻，甚至呕血、发狂、昏厥，舌红苔黄，脉弦劲有力（E错）。